患者女性，20岁。因左侧后牙进食时嵌塞食物疼痛就诊。检查：左下6（牙合）面龋洞，探洞底敏感，叩（-），冷刺激入洞后疼痛，去除刺激立即消失，热测同对照牙。该牙诊断可能为
A. 浅龋
B. 中龋
C. 深龋
D. 慢性牙髓炎
E. 急性牙髓炎

正确答案：C。深龋

解析：本题考查深龋。患者女性，20岁。因左侧后牙进食时嵌塞食物疼痛就诊。检查：左下6（牙合）面龋洞，探洞底敏感，叩（-），冷刺激入洞后疼痛，去除刺激立即消失，热测同对照牙。该牙诊断可能为深龋（C对）。深龋病变进展到牙本质深层，探诊龋洞敏感，食物嵌入洞中，压迫牙髓使压力增加，产生疼痛，冷水入洞后可引起疼痛，刺激去除后症状立即消失。浅龋位于釉质内，患牙一般无主观症状，遭受外界的物理和化学刺激时亦无明显反应（A错）。龋病发展到牙本质时为中龋，中龋时患者对酸甜饮食敏感，过冷过热饮食能产生痛觉，冷刺激尤为显著，食物嵌入龋洞不引起疼痛（B错）。慢性牙髓炎有时可有不明显的阵发性隐痛或每日出现定时钝痛，患者可有很长时间的冷热刺激痛史，对温度刺激的反应可为敏感，也可为迟热侧引起的迟缓性疼痛，多有叩诊不适（D错）。急性牙髓炎的典型特征为自发性阵发性疼痛，冷热刺激引发剧烈疼痛并持续一段时间（E错）。